中国高脂血症预防指南（2007版）中将血脂通常分为哪三类
A. 高胆固醇血症
B. 高三酰甘油血症
C. 混合高血脂症
D. 高密度脂蛋白血症
E. 低密度脂蛋白血症

正确答案：A、B、C、E。高胆固醇血症；高三酰甘油血症；混合高血脂症；低密度脂蛋白血症

解析：本题考查血脂的分类。高脂血症的分型：高胆固醇血症（A对）、高三酰甘油血症（B对）、混合型高脂血症（C对）、低高密度脂蛋白血症（E对）。